椎骨间的连结包括椎体间的连结和椎弓间的连结。椎体间的连结是各相邻椎体之间借椎间盘、前纵韧带和后纵韧带等相连结。椎弓间的连结包括黄韧带、棘间韧带和棘上韧带。后纵韧带、黄韧带、棘间韧带和棘上韧带都有限制脊柱过度前屈的作用。椎间盘脱出症时，髓核脱出的常见方位是
A. 前
B. 后
C. 前外侧
D. 后外侧
E. 以上均不是

正确答案：D。后外侧

解析：由于椎间盘后面是椎间孔或者椎管，所以当受到巨大压力后，易从后外侧（D对）脱出。